腮腺是最大的一对唾液腺，其导管开口在
A. 颧弓下方一横指处
B. 下颌第二磨牙相对的颊黏膜处
C. 下颌第一磨牙相对的颊黏膜处
D. 平对上颌第二磨牙相对的颊黏膜处
E. 舌下阜

正确答案：D。平对上颌第二磨牙相对的颊黏膜处

解析：腮腺管开口于平对上颌第二磨牙牙冠相对的颊粘膜处(D对)的腮腺管乳头。